紫杉醇的结构类型是
A. 黄酮
B. 多元酚
C. 二萜
D. 环烯醚萜
E. 倍半萜

正确答案：C。二萜